患者，女，27岁，主诉外阴瘙痒。妇科检查见阴道黏膜覆盖白色豆腐渣样物，擦除后露出红肿黏膜面，诊断为外阴阴道假丝酵母菌感染。宜选用的药物是
A. 尼尔雌醇
B. 咪康唑
C. 克林霉素
D. 甲硝唑
E. 庆大霉素

正确答案：B。咪康唑

解析：本题考查外阴阴道假丝酵母菌感染的药物治疗。外阴阴道假丝酵母菌病的治疗原则：首先消除诱因，及时停用广谱抗菌药、雌激素等药物，积极治疗糖尿病。患者应勤换内裤，使用过的毛巾等生活用品以开水烫洗。根据患者情况选择局部或全身应用抗真菌药物（如克霉唑制剂、咪康唑（B对）制剂、制霉菌素制剂），以局部用药为主。